属于自然疫源性烈性传染病，又属于人畜共患病的是
A. 鼠疫
B. 放线菌病
C. 流行性脑膜炎
D. 麻风病
E. 白喉

正确答案：A。鼠疫

解析：鼠疫属于动物源性细菌，为人兽共患疾病的病原菌，其中由鼠疫耶尔森氏菌引起的鼠疫，为自然疫源性的烈性传染病。掌握“动物源性细菌”知识点。